可能发生髋关节畸形的疾病是
A. 流火
B. 有头疽
C. 环跳疽
D. 历节风
E. 髂窝流注

正确答案：C。环跳疽

解析：环跳疽是发生于环跳穴（髋关节）的急性化脓性疾病，好发于4～14岁儿童，男性多于女性，因为病变部位深，病程时间长，晚期可使关节畸形，僵硬，不能活动或造成脱位等（C对）。发于小腿足部者，称流火（A错）；有头疽是发于肌肤间的急性化脓性疾病（B错）；历节风以关节红肿，剧烈疼痛，不能屈伸为特点（D错）；髂窝流注仅发于髂窝部一侧，大腿部屈而难伸，1～2个月恢复正常（E错）。